在原发性肾病综合征中，关于微小病变型肾病的特点，叙述不正确的是
A. 光镜下肾小球基本正常，可见近曲小管上皮细胞脂肪变性
B. 免疫荧光检查阴性
C. 电镜下于系膜区可见电子致密物
D. 镜下血尿发生率低，一般不出现肉眼血尿
E. 对激素治疗敏感．

正确答案：C。电镜下于系膜区可见电子致密物

解析：微小病变型肾病在光镜下肾小球无明显病变，近端肾小管上皮细胞可见脂肪变性（A对），免疫病理检查阴性（B对）。典型的临床表现为肾病综合征，约15%的病人有镜下血尿，一般不出现肉眼血尿（D对），且90%病例对糖皮质激素治疗敏感（E对），故C错，为本题正确答案。